上颌窦填塞法适用于
A. 上颌骨前壁骨折
B. 上颌骨外下壁骨折
C. 颧弓骨折
D. 颧骨颧额缝骨折
E. 颧骨粉碎性骨折

正确答案：E。颧骨粉碎性骨折

解析：本题考查上颌窦填塞法的适应证。上颌窦填塞法是在尖牙窝处上颌前庭沟作切口，显露上颌窦，用骨膜分离器置入上颌窦内，将骨折片复位，用碘仿纱条进行上颌窦填塞，从下鼻道开窗引流，2周后逐步抽出碘仿纱条，适用于颧骨粉碎性骨折（E对）。上颌骨前壁骨折需复位后固定（A错）。上颌骨外下壁骨折即牙槽突骨折，应在麻醉下进行手法复位（B错）。颧弓骨折时可根据骨折的程度选择巾钳牵拉复位、颧弓单齿钩切开复位等方法（C错）。颧骨颧额缝骨折需要切开复位（D错）。